下列有关白血病龈病损的治疗错误的是
A. 已确诊白血病时及时与内科医师配合进行治疗
B. 牙周的治疗以保守为主
C. 牙龈坏死且出血时用3%过氧化氢轻轻清洗坏死龈缘
D. 对急性白血病患者一般不作洁治
E. 对患者进行口腔卫生指导

正确答案：C。牙龈坏死且出血时用3%过氧化氢轻轻清洗坏死龈缘

解析：白血病龈病损的治疗：①在可疑或已确诊为白血病时，应及时与内科医师配合进行治疗。②牙周的治疗以保守为主，切忌进行手术或活组织检查，以免发生出血不止或感染、坏死。遇出血不止时，可采用局部压迫方法或药物止血，必要时可放牙周塞治剂。③在有牙龈坏死时，在无出血情况下，可用3%过氧化氢轻轻清洗坏死龈缘，然后敷以消炎药或碘制剂。④用0.12%～0.2%氯已定溶液含漱有助于减少菌斑、消除炎症。⑤对急性白血病患者一般不作洁治，若全身情况允许，必要时可进行简单的洁治术，但应特别注意动作轻柔，避免引起出血和组织创伤。⑥对患者进行口腔卫生指导，加强口腔护理，防止菌斑堆积，减轻炎症。掌握“白血病龈病损”知识点。